低血钾性周期性麻痹的诊断意义主要在于提示及时给予
A. 氯化钾
B. 碳酸氢钠溶液
C. 螺内酯
D. 新斯的明
E. 肾上腺皮质激素

正确答案：A。氯化钾

解析：低血钾性周期性麻痹的诊断意义主要在于提示及时给予氯化钾（A对）。低血钾性周期性麻痹是指因血钾降低而导致的反复发作驰缓性骨骼肌瘫痪或无力。血钾浓度常低于3.5mmol/L，可见需要及时给予氯化钾（A对）。低血钾常并发碱中毒，给予碳酸氢钠溶液（B错）会加重碱中毒。新斯的明（D错），多用于重症肌无力及腹部手术后的肠麻痹。肾上腺皮质激素（E错）中醛固酮成分会促进肾脏保钠排钾，加重低钾血症。我们最容易混淆的是选择给予氯化钾（A对）还是螺内酯（C错）。由于螺内酯起效缓慢而持久，很难及时缓解周期性麻痹的症状，并且长期服用螺内酯（C错）有诱发高血钾的风险，因此不予优先考虑。